治疗阳痿肾阳不足证，可选用的中成药有
A. 六味地黄丸
B. 附子理中丸
C. 蚕蛾公补片
D. 人参归脾丸
E. 桂附地黄丸

正确答案：C。蚕蛾公补片

解析：本题考查的是阳痿的辨证论治。治疗阳痿肾阳不足证，可选用的中成药有蚕蛾公补片（C对）。阳痿肾阳不足：【中成药应用】常用中成药有益肾灵颗粒、强龙益肾胶囊、蚕蛾公补片、海龙蛤蚧口服液、建阳片。六味地黄丸（A错）为消渴肾阴亏虚证的中成药应用。消渴肾阴亏虚证：【中成药应用】常用中成药有六味地黄丸（水蜜丸）、麦味地黄丸（水蜜丸）。附子理中丸（B错）为口疮脾肾阳虚证的中成药应用。口疮脾肾阳虚证：【中成药应用】常用中成药有附子理中丸、金匮肾气丸。人参归脾丸（D错）为心悸心脾两虚证的中成药应用。心悸心脾两虚证：【中成药应用】常用中成药有人参归脾丸（大蜜丸）、复方扶芳藤合剂、益气养血口服液、消疲灵颗粒。桂附地黄丸（E错）为肾虚腰痛的中成药应用。肾虚腰痛：【中成药应用】常用中成药有左归丸、鱼鳔丸、七宝美髯丸、腰痛片、杜仲补天素片、桂附地黄丸（水蜜丸）、济生肾气丸（水蜜丸）、杜仲颗粒。